配制静脉输液时，应选择氯化钠注射液或乳酸钠林格注射液稀释，不得使用葡萄糖注射液稀释的抗真菌药是
A. 氟康唑
B. 卡泊芬净
C. 伏立康唑
D. 两性霉素B
E. 伊曲康唑

正确答案：B。卡泊芬净

解析：本题考查药物的用法。卡泊芬净（B错，为本题正确答案）配制静脉输液时，应选择氯化钠注射液或乳酸钠林格注射液稀释，不得使用葡萄糖注射液，因为卡泊芬净在含有葡萄糖的稀释液中不稳定。不得将卡泊芬净与任何其他药物混合或同时输注。